Meta分析汇总异质性检查目的是检查各个独立研究结果的
A. 真实性
B. 同质性
C. 代表性
D. 敏感性
E. 可靠性

正确答案：B。同质性

解析：Meta分析汇总异质性检查目的是检查各个独立研究结果同质性（B对）。Meta分析中对每个独立研究是否来自同一总体做统计学检验，称之为异质性检验。检验是否来同一总体，虽然名为异质性检验，实质研究的是他们的同质性（B对）。Meta分析敏感性（D错）分析的目的是检验研究结果的可靠性（E错）和发现产生不同结果的原因。